疱在基底层之下，基底细胞变性，使上皮全层与固有层分离为以下哪项病变的表述
A. 棘层内疱
B. 棘层松解
C. 角化不良
D. 异常增生
E. 基层下疱

正确答案：E。基层下疱

解析：基层下疱：疱在基底层之下，基底细胞变性，使上皮全层与固有层分离。掌握“口腔黏膜基本病理变化”知识点。